治疗痛经气滞血瘀证，应首选
A. 血府逐瘀汤
B. 膈下逐瘀汤
C. 少腹逐瘀汤
D. 身痛逐瘀汤
E. 通窍活血汤

正确答案：B。膈下逐瘀汤

解析：痛经气滞血瘀证的病机是气滞血瘀，血行失畅，瘀阻子宫、冲任；治宜理气活血，逐瘀止痛；膈下逐瘀汤功能理气行滞，化瘀止痛，切合病机（B对）。血府逐疲汤（A错），具有活血化瘀，行气止痛之功效；主治胸中血瘀证。少腹逐瘀汤（C错），具有活血祛瘀，温经止痛之功效；主治寒凝血瘀证。身痛逐瘀汤（D错），具有活血行气，祛风除湿，通痹止痛之功效；主治瘀血痹阻经络证。通窍活血汤（E错）具有活血通窍之功效；主治瘀阻头面证。